以下哪项属于影响传染病流行过程的自然环境因素
A. 社会制度
B. 地貌水文
C. 经济水平
D. 文化教育
E. 卫生服务

正确答案：B。地貌水文